用于无机器清洗的设备或一些复杂物品清洗
A. 手工清洗
B. 清洗机清洗
C. 超声波清洗
D. 消毒
E. 灭菌

正确答案：A。手工清洗

解析：手工清洗：对于无机器清洗的设备或一些复杂物品如各种内镜、导管等必须手工清洗。清洗人员须注意自身保护：戴厚的橡胶手套：戴面罩以保护眼、鼻、口黏膜；穿防水衣服或穿围裙和袖套；头套完全遮盖头发。将器械置于流动水下冲洗，清洗时水温宜为15～30℃。去除干燥的污渍应先用酶清洁剂浸泡，再刷洗。刷洗应在水面下进行，以防止产生气溶胶。管腔器械应用压力水枪冲洗，可拆卸部分应拆开后清洗。掌握“口腔器械的消毒与灭菌及医疗废物处理”知识点。